患儿，12岁。两小腿皮肤出现米粒大小的斑疹，其色鲜红、微痒、触之碍手。治疗应首选
A. 清营汤
B. 黄连解毒汤
C. 透疹凉解汤
D. 犀角地黄汤
E. 清热泻脾散

正确答案：D。犀角地黄汤

解析：患儿以两小腿皮肤出现米粒大小的斑疹为特征，当属紫癜，治疗紫癜的方剂有犀角地黄汤、连翘败毒散、归脾汤、大补阴丸（D对）。清营汤主治热入营分证，症见身热夜甚，口渴或不渴，时有谵语，心烦不眠，或斑疹隐隐（A错）。黄连解毒汤善治三焦火热证，症见大热烦渴，或热病吐血、衄血，或热甚发斑，外科痈疽疔毒，舌红苔黄（B错）。透疹凉解汤主治邪入气营的风疹，症见壮热烦躁、疹点密集、色鲜红或紫暗（C错）。清热泻脾散治疗心脾积热的鹅口疮，症见口腔舌面白屑较多，周围焮红（E错）。